《中华人民共和国刑法》关于生产、销售伪劣商品罪规定，生产、销售假药致人死亡或对人体健康造成特别严重危害的
A. 处三年以下有期徒刑或者拘役，并处罚金
B. 处三年以上十年以下有期徒刑，并处罚金
C. 处十年以上有期徒刑、无期徒刑或者死刑，并处罚金
D. 处二年以下有期徒刑或者拘役，并处或单处罚金
E. 处二年以上七年以下有期徒刑并处罚金

正确答案：C。处十年以上有期徒刑、无期徒刑或者死刑，并处罚金

解析：本题考查生产、销售伪劣商品罪。《中华人民共和国刑法》关于生产、销售伪劣商品罪规定，生产、销售假药致人死亡或对人体健康造成特别严重危害的处十年以上有期徒刑、无期徒刑或者死刑，并处罚金（C对）。《中华人民共和国刑法》第三章破坏社会主义市场经济秩序罪第一节生产、销售伪劣商品罪第一百四十条：生产者、销售者在产品中掺杂、掺假，以假充真，以次充好或者以不合格产品冒充合格产品，销售金额五万元以上不满二十万元的，处二年以下有期徒刑或者拘役，并处或者单处销售金额百分之五十以上二倍以下罚金（D错）；销售金额二十万元以上不满五十万元的，处二年以上七年以下有期徒刑，并处销售金额百分之五十以上二倍以下罚金（E错）；销售金额五十万元以上不满二百万元的，处七年以上有期徒刑，并处销售金额百分之五十以上二倍以下罚金；销售金额二百万元以上的，处十五年有期徒刑或者无期徒刑，并处销售金额百分之五十以上二倍以下罚金或者没收财产。第一百四十一条：生产、销售假药的，处三年以下有期徒刑或者拘役，并处罚金（A错）；对人体健康造成严重危害或者有其他严重情节的，处三年以上十年以下有期徒刑，并处罚金（B错）；致人死亡或者有其他特别严重情节的，处十年以上有期徒刑、无期徒刑或者死刑，并处罚金或者没收财产。本条所称假药，是指依照《中华人民共和国药品管理法》的规定属于假药和按假药处理的药品、非药品。